有助于再障与急性白血病鉴别的是
A. 感染发热
B. 皮肤黏膜出血
C. 贫血苍白
D. 胸骨压痛
E. 网织红细胞减少

正确答案：D。胸骨压痛

解析：有助于再障与急性白血病鉴别的是胸骨压痛（D对），胸骨压痛为急性白血病特有表现，而再障患者无胸骨压痛。感染发热（A错）、皮肤黏膜出血（B错）、贫血苍白（C错）及网织红细胞减少（E错）为再障与急性白血病的共有表现。